患者男性，55岁，因右上颌牙痛三天，右侧眼下、鼻侧肿胀一天而就诊。检查：右侧上颌尖牙远中深龋，探（-），叩（++），松动（-），前庭沟肿胀变浅，同侧鼻侧、眶下区肿胀明显，局部皮温增高，压痛和波动感存在，眼裂变小。体温40℃，食欲下降，精神萎靡。该患者最有可能的诊断为右侧眶下间隙感染，该患者外科治疗的切口应选择在
A. 右上颌尖牙前庭沟黏膜转折处
B. 右上颌中切牙前庭沟黏膜转折处
C. 右侧鼻旁皮肤
D. 右上颌磨牙区前庭沟黏膜转折处
E. 右侧口内和口外联合切口

正确答案：A。右上颌尖牙前庭沟黏膜转折处

解析：本题考查眶下间隙感染治疗时的切口选择。眶下间隙感染切开引流，常在口内右上颌尖牙口腔前庭黏膜转折处（A对）作切口。眶下间隙感染多来自上颌尖牙、第一前磨牙和上颌切牙的根尖化脓性炎症和牙槽脓肿。切开引流时，按低位引流原则常在口内上颌尖牙及前磨牙唇侧口腔前庭黏膜转折处作切口。